在医疗实践中，医务人员应具备的最起码医德情感是
A. 克己
B. 正直
C. 同情
D. 有利
E. 公正

正确答案：C。同情

解析：医德情感是指医务人员在医疗活动中所产生的职业道德情感，即对医德生活的内心体验、态度及其自然流露。医德情感包括同情感、责任感和事业感。在医疗实践中，医务人员应具备的最起码医德情感是同情（C对），表现为对病人的遭遇、痛苦和不幸能够理解，在感情上产生共鸣，在道义上、行动上给予支持和帮助，是促使医务人员为病人服务的原始动力。